我国公共场所按其用途分为4类，不包括
A. 生活服务设施
B. 住宅小区
C. 文化体育设施
D. 公共文化设施
E. 公共交通设施

正确答案：B。住宅小区

解析：本题考查我国公共场所按其用途的分类。公共场所是根据公众生活活动和社会活动的需要，人工建成的具有多种服务功能的公共建筑设施，供公众进行学习、工作、休息、文体、娱乐、参观、旅游、交流、交际、购物、美容等活动之用。我国公共场所按其用途可分为四类：1.生活服务设施类（A对），包括宾馆、旅馆、招待所、车马店、饭馆、咖啡馆、酒吧、茶座、公共浴室、理发店、美容店、影剧院、录像厅（室）、游艺厅（室）、舞厅、音乐厅、银行和邮政营业厅、照相馆（婚纱影楼）、殡仪馆、商城（集市）、书店、候诊室等；2.体育设施类（C对），包括体育场（馆）、游泳场（馆）、健身房等；3.公共文化设施类（D对），包括展览馆、博物馆、美术馆、图书馆、公园等；4.公共交通设施类（E对），包括候车（机、船）室、公共交通工具（汽车、火车、飞机和轮船）等。住宅小区（B错，为本题正确答案）不是我国公共场所按其用途的分类。